可作为粉末直接压片“干黏合剂”使用的辅料是
A. 硫酸钙
B. 微晶纤维素
C. 淀粉
D. 糖粉
E. 药用碳酸钙

正确答案：B。微晶纤维素

解析：本题考查片剂的常用辅料。微晶纤维素（B对）（MCC）具有良好的结合力与良好的可压性，亦有“干黏合剂”之称，可用作粉末直接压片。淀粉（C错）常与可压性较好的蔗糖粉、糊精等混合使用。糖粉（D错）系指结晶性蔗糖经低温干燥粉碎后而成的白色粉末，其优点是黏合力强、可用来增加片剂的硬度，缺点是吸湿性较强。硫酸钙（A错）与药用碳酸钙（E错）为无机盐类填充剂，不用于粉末直接压片。